某女，35岁。患慢性宫颈炎，症见带下量多、色黄质稠、臭秽、小腹疼痛、腰骶酸痛、神疲乏力。治当清热除湿、益气化瘀，宜选用的成药是
A. 妇炎平胶囊
B. 益母草胶囊
C. 千金止带丸
D. 宫血宁胶囊
E. 妇科千金片

正确答案：E。妇科千金片

解析：本题考查的是妇科千金片的功能。某女，35岁。患慢性宫颈炎，症见带下量多、色黄质稠、臭秽、小腹疼痛、腰骶酸痛、神疲乏力。治当清热除湿、益气化瘀，宜选用的成药是妇科千金片（E对）。妇科千金片：【功能】清热除湿，益气化瘀。妇炎平胶囊（A错）：【功能】清热解毒，燥湿止带，杀虫止痒。益母草胶囊（B错）：【功能】活血调经。千金止带丸（C错）：【功能】健脾补肾，调经止带。宫血宁胶囊（D错）：【功能】凉血止血，清热除湿，化瘀止痛。